土壤的生物性污染对人类健康有很大威胁，下列哪种疾病可以直接由土壤传播给人类
A. 肠道传染病
B. 寄生虫病
C. 钩端螺旋体病
D. 肉毒中毒病
E. 军团菌病

正确答案：D。肉毒中毒病

解析：本题考查直接由土壤传播给人类的疾病。肉毒中毒病（D对ABCE错）是一种由肉毒梭菌引起的传染病，它可以直接由土壤传播给人类。肉毒梭菌抵抗力很强，可以在土壤中长期存活。